进行随机抽样调查时，为保证所有个体或单位都有同等被抽到的机会，必须做到
A. 调查材料的分布要均匀，样本要够大，抽样要随机
B. 定出所需的真实性和可靠性
C. 有充分的人力、物力准备，在规定的时间内做好调查
D. 避免抽样误差和非抽样误差
E. 根据估计的现患率来考虑样本大小

正确答案：A。调查材料的分布要均匀，样本要够大，抽样要随机

解析：本题考查抽样调查的要求。抽样调查是指通过随机抽样的方法，对特定时点、特定范围内人群的一个代表性样本进行调查，以样本的统计量来估计总体参数所在范围。抽样调查的基本要求是能将从样本获得的结果推论到整个群体（总体）。为此，抽样必须随机化，样本量要足够（A对BCDE错）。